手术创伤并术后禁食期间，患者机体代谢变化为
A. 蛋白分解减少，糖异生减少、脂肪分解减少
B. 蛋白分解增加，糖异生减少，脂肪分解增加
C. 蛋白分解增加、糖异生增加，脂肪分解增加
D. 蛋白分解增加、糖异生减少，脂肪分解减少
E. 蛋白分解减少，糖异生增加，脂肪分解减少

正确答案：C。蛋白分解增加、糖异生增加，脂肪分解增加

解析：手术创伤并术后禁食期间机体处于应激状态，在应激状态下机体通过增加蛋白分解，增加糖异生，增加脂肪分解，来维持组织、器官功能以及生存所需（C对）。